热疮的治疗原则是
A. 清热利湿行气
B. 清热解毒散结
C. 清热解毒养阴
D. 清热化痰止痛
E. 疏风清热止痒

正确答案：C。清热解毒养阴

解析：热疮为外感风温热毒，阻于肺胃二经，蕴蒸皮肤而生；或由肝经湿热下注，阻于阴部而成疮；或因反复发作，热邪伤津，阴虚内热所致，因此治疗时当清热解毒养阴（C对）。